牙周膜的厚度在不同的人和不同的牙是不同的，一般为
A. 0.01～0.38mm
B. 0.15～0.38mm
C. 0.05～0.38mm
D. 0.10～0.38mm
E. 0.20～0.38mm

正确答案：B。0.15～0.38mm

解析：本题考查牙周膜的厚度。牙周膜又称牙周韧带，是围绕牙根并连接牙根和牙槽骨的致密结缔组织，与牙龈的结缔组织相延续，厚度为0.15～0.38mm（B对），以牙根中部支点附近最窄，牙槽嵴顶及根尖孔附近较宽。这种微小的差异在X线上不能显示，整个牙周膜呈围绕牙根的窄黑线。但需要提及的是，健康牙的牙槽嵴顶处有5.5%的牙周膜间隙呈楔形增宽，主要分布在尖牙和第一第二磨牙区。这可能是由于正常牙可承受范围内的过大咬合力所致，是生理适应过程，而非病损。